男，72岁。脑血管病患者。住院期间突然半夜起床活动。无目的地摸床，摸墙，摸病友的头，自语，白天安静入睡。该患者最可能的诊断是
A. 阿尔兹海默病
B. 脑肿瘤
C. 帕金森病
D. 老年性痴呆
E. 血管性痴呆

正确答案：E。血管性痴呆

解析：患者为老年男性，有脑血管病史，突发精神神智异常症状。考虑诊断为血管性痴呆（E对）。阿尔兹海默病（A错）又叫老年性痴呆（D错），起病隐匿，呈持续进行性发展，主要表现为记忆障碍、视空间障碍和人格改变（P219）。脑肿瘤（B错）典型表现会出现颅内压迫症状，且症状无时间相关性，无自语等精神症状表现。帕金森病（C错）典型表现为静止性震颤、行动迟缓、肌强直和姿势平衡障碍（P279）。